维生素A缺乏时引起
A. 癞皮病
B. 脚气病
C. 夜盲症
D. 坏血病
E. 佝偻病

正确答案：C。夜盲症

解析：维生素A缺乏时引起夜盲症（C对）。癞皮病（A错）是由维生素PP缺乏引起的；脚气病（B错）是由维生素B₁缺乏引起的；坏血病（D错）是由于维生素C缺乏引起的；佝偻病（E错）是由维生素D缺乏引起的。